以下哪项不是平滑面龋损的好发部位
A. 近中邻面接触点以下
B. 远中邻面接触点以下
C. 颊面近龈缘牙颈部
D. 舌面近龈缘牙颈部
E. 牙冠颊面中1/3处

正确答案：E。牙冠颊面中1/3处

解析：平滑面龋多见于牙齿邻面接触点下方、颊舌面近龈缘牙颈部。掌握“牙釉质龋”知识点。